有关HEV，下述哪项不正确
A. 病人粪便可排出HEV
B. HEV的抗原血症持续时间短
C. 感染后，血清抗体反应低
D. 感染后血清抗体持续时间短
E. HEV较HAV对外界环境抵抗力强

正确答案：E。HEV较HAV对外界环境抵抗力强

解析：本题考查戊肝的特点。HEV可随病人的粪便被排出体外（A对）；HEV的抗原血症持续时间较短（B对）；感染HEV病毒后，血清抗体反应低（C对），血清抗体持续时间短（D对）。HEV较HAV对外界环境抵抗力弱（E错，为本题正确答案）。